患者，男，20岁。突发胸闷，带哮鸣音的呼气性呼吸困难，咳嗽。听诊两肺满布哮鸣音。应首先考虑的诊断是
A. 急性支气管炎
B. 支气管哮喘
C. 慢性支气管炎喘息型
D. 心源性哮喘
E. 气胸

正确答案：B。支气管哮喘

解析：患者青年男性，突发胸闷，带哮鸣音的呼吸性呼吸困难，咳嗽，听诊两肺满布哮鸣音，与支气管哮喘表现相符，故患者应首先考虑的诊断是支气管哮喘（B对）。心源性哮喘常有心功能不全的表现（D错）。急性支气管炎全身症状较轻，可有发热，初为干咳或少量粘液痰，偶伴痰中带血（A错）。慢性支气管炎喘息型表现为咳嗽、咳痰、喘息或气急（C错）。气胸，大多数起病急骤，患者突感一侧针刺样或刀割样胸痛，继之出现胸闷和呼吸困难等（E错）。